肉眼见肿瘤与多形性腺瘤相似，由黏液细胞、中间细胞和表皮样细胞构成的恶性唾液腺肿瘤是
A. 恶性多形性腺瘤
B. 腺泡细胞癌
C. 黏液表皮样癌
D. 腺样囊性癌
E. 多形性低度恶性腺癌

正确答案：C。黏液表皮样癌

解析：黏液表皮样癌是由黏液细胞、中间细胞和表皮样细胞构成的恶性唾液腺上皮性肿瘤，肉眼见高分化型者与多形性腺瘤相似。掌握“腺泡细胞癌”知识点。